男，60岁。结肠癌术后1天，半夜出现兴奋躁动，钻到病床下，大声说阎王派小鬼来抓他了，不识家人，白天昏睡。该患者最可能的状态是
A. 痴呆状态
B. 应激状态
C. 躁狂状态
D. 抑郁状态
E. 谵妄状态

正确答案：E。谵妄状态

解析：患者结肠癌术后（诱因），半夜出现兴奋躁动（情绪异常），钻到病床下，大声说阎王派小鬼来抓他了（幻觉），不识家人（人物定向障碍），白天昏睡（昼夜颠倒，昼轻夜重）。最可能的状态是谵妄状态（E对）。痴呆状态（A错）多表现为患者铭记功能受损，尤其是近期发生的事，情绪不稳定，易哭易笑（P50）。